以下边缘类型中密合度最差的是
A. 刃状
B. 90°肩台
C. 90°肩台加斜面
D. 凹面
E. 135°肩台

正确答案：B。90°肩台

解析：本题考查修复体龈边缘外形的选择应用。修复体的边缘形态包括：刃状，斜面，凹槽（凹面），深凹槽，肩台（90°肩台，135°肩台），带斜坡肩台（90°肩台加斜面）。其中90°肩台（B对）磨除的牙体组织多，边缘密合度最差。刃状（A错）、90°肩台加斜面（C错）、凹面（D错）、135°肩台（E错）的密合度均比直角肩台强。